下列哪一阶段不是肉类腐败变质的典型过程
A. 僵直
B. 后熟
C. 自溶
D. 腐败
E. 混浊

正确答案：E。混浊